眼用制剂贮存应密封避光，启用后最多可用
A. 1周
B. 4周
C. 2周
D. 3周
E. 5周

正确答案：B。4周

解析：本题考查眼用制剂的质量要求。眼用制剂贮存应密封避光，启用后最多可用4周（B对）。